下列试剂中，常用于沉淀血浆样品中蛋白质的有
A. 甲醇
B. 乙腈
C. 三氯醋酸
D. 生理盐水
E. 肝素

正确答案：A、B、C。甲醇；乙腈；三氯醋酸

解析：本题考查蛋白沉淀法。蛋白沉淀法常用的方法包括：加入有机溶剂（甲醇（A对）、乙腈（B对）、丙酮、三氯醋酸（C对）、四氢呋喃等）、强酸（10%三氯醋酸、6%高氯酸等）和无机盐（饱和硫酸铵、硫酸钠、硫酸镁、氯化钠、硫酸钠等）。